苯巴比妥不具有下列哪项作用
A. 镇静
B. 催眠
C. 镇痛
D. 抗惊厥
E. 抗癫痫

正确答案：C。镇痛

解析：本题考查苯巴比妥。苯巴比妥与乙醚等全麻药不同，其对丘脑新皮层通路无抑制作用，故无镇痛作用（C错，为本题正确答案）；苯巴比妥可引起中枢神经系统非特异性抑制作用，有镇静（A对）、催眠（B对）、抗惊厥（D对）和抗癫作用（E对）。